高血压患者余某，体重75kg，收缩压170mmHg，舒张压98mmHg，心电图不正常，ST-T改变，有大量饮酒嗜好。针对可能出现的高血压的并发症，医生建议其戒酒、控制体重是
A. 治疗措施
B. 特殊保护
C. 第一级预防措施
D. 第二级预防措施
E. 第三级预防措施

正确答案：C。第一级预防措施